根据《药品广告审查办法》，在受理审查中发现某企业提供虚假材料申请药品广告批准文号的，药品广告审查机关应当
A. 责令停止发布广告，责令广告主在相应范围内消除影响
B. 1年内不受理该申请人的广告审查申请
C. 3年内不受理该申请人的广告审查申请
D. 申请撤销该企业所有品种的广告批准文号
E. 责令停产该品种的生产

正确答案：B。1年内不受理该申请人的广告审查申请

解析：本题考查违反药品广告管理的处罚。根据《药品广告审查办法》，在受理审查中发现某企业提供虚假材料申请药品广告批准文号的，药品广告审查机关应当1年内不受理该申请人的广告审查申请（B对）。以不当方式获得广告批准文件的处罚：隐瞒真实情况或者提供虚假材料申请药品、医疗器械、保健食品和特殊医学用途配方食品广告审查的；或者以欺骗、贿赂等不正当手段取得药品、医疗器械、保健食品和特殊医学用途配方食品广告批准文号的，按照《广告法》第六十五条处罚，广告审查机关不予受理或者不予批准，予以警告，一年内不受理该申请人的广告审查申请；以欺骗、贿赂等不正当手段取得广告审查批准的，广告审查机关予以撤销，处十万元以上二十万元以下的罚款，三年内不受理该申请人的广告审查申请（C错）。